逗点状，只有一个弯曲，长2～3μm的是
A. 弧菌
B. 螺菌
C. 螺杆菌
D. 弯曲菌
E. 杆菌

正确答案：A。弧菌

解析：弧菌，为弧状或逗点状，只有一个弯曲，长2～3μm，如霍乱弧菌。掌握“细菌的特殊结构及检查方法”知识点。